艾附暖宫丸适用于
A. 月经后期，血寒证
B. 月经后期，虚寒证
C. 月经先后无定期，肝郁证
D. 月经先后无定期，肾虚证
E. 月经先后无定期，肾虚肝郁证

正确答案：B。月经后期，虚寒证

解析：月经后期，虚寒证的病机是阳虚内寒，脏腑失于温养，生化失期，气虚血少，冲任亏虚；艾附暖宫丸的功效为理气养血，调经暖宫；契合病机（B对）。月经后期血寒证（A错），方用温经汤；月经先后无定期，肝郁证（C错）方宜逍遥散；月经先后无定期，肾虚证（D错）方用固阴煎；月经先后无定期，肾虚肝郁证（E错）方用定经汤。